先天性甲状腺功能减退症在新生儿期最早引起注意的临床表现是
A. 特殊面容
B. 智能发育落后
C. 生理期黄疸时间延长
D. 皮肤粗糙
E. 生长发育迟缓

正确答案：C。生理期黄疸时间延长

解析：新生儿期是自胎儿娩出脐带结扎时开始至28天之前，先天性甲状腺功能减退症在新生儿期最早引起注意的临床表现是生理期黄疸时间延长（C对），新生儿期出现的症状还有前后囟大，胎便排除延迟，四肢冷，特殊面容，皮肤出现斑纹或有硬肿现象等。特殊面容（A错）、智能发育落后（B错）、皮肤粗糙（D错）、生长发育迟缓（E错）均为先天性甲状腺功能减退症患儿半年后常出现的典型症状。